上颌尖牙唇面外形高点的位置是
A. 颈缘处
B. 舌隆突处
C. 颈嵴处
D. 中1/3处
E. 中1/3与颈1/3交界处

正确答案：E。中1/3与颈1/3交界处

解析：上颌尖牙唇面的外形高点在中1/3与颈1/3交界处的唇轴嵴上。掌握“牙的萌出、更替及牙体解剖名词、标志”知识点。